血证可闻及的口气是
A. 臭秽
B. 腥臭
C. 臭腐
D. 酸腐
E. 酸腐而臭

正确答案：B。腥臭

解析：嗅气味包括病儿口中之气味及大小便、呕吐物等的气味。口气臭秽，多属胃热（A错）；嗳气酸腐，多为伤食（D错）；口气腥臭，见于血证（B对），如齿衄；口气如烂苹果味，为酸中毒的表现；口有肝腥臭，为肝硬化后期。